应激反应时血中明显增多的激素是
A. 皮质醇
B. 醛固酮
C. 胰岛素
D. 抗利尿激素
E. 雄激素

正确答案：A。皮质醇